下列哪种搭配是正确的
A. 隐性感染——自然被动免疫
B. 接种疫苗——人工主动免疫
C. 接种类毒素——人工被动免疫
D. 注射抗毒素——人工主动免疫
E. 从初乳中获得SIgA——人工被动免疫

正确答案：B。接种疫苗——人工主动免疫